运动幅度极小的关节是
A. 肩关节
B. 桡腕关节
C. 拇指腕掌关节
D. 膝关节
E. 骶髂关节

正确答案：E。骶髂关节

解析：平面关节由于关节面大小互相一致，关节囊紧张而坚固，所运动幅度极小，又叫做微动关节，骶髂关节（E对）属于平面关节。